田间下风侧喷洒有机磷农药时，发生中毒的最主要原因是
A. 呼吸道吸入有机磷农药
B. 皮肤污染
C. 通过污染的手拿食物经消化道摄入
D. 体质虚弱
E. 以上都不是

正确答案：A。呼吸道吸入有机磷农药